低钾血症对酸碱平衡的影响
A. 细胞内酸中毒，细胞外碱中毒
B. 细胞内外均酸中毒
C. 细胞内外均碱中毒
D. 细胞内碱中毒，细胞外正常
E. 细胞内碱中毒，细胞外酸中毒

正确答案：A。细胞内酸中毒，细胞外碱中毒

解析：低钾血症时细胞内液k＋向浓度相对低的外液转移，而细胞外液H＋内移以维持电荷平衡，而引起细胞内酸中毒，细胞外碱中毒（A对）。高钾血症时细胞内碱中毒，细胞外酸中毒（E错）。